起病日期、发病情况及有关发病因素等应记入
A. 现病史
B. 既往史
C. 个人史
D. 月经及婚育史
E. 家族史

正确答案：A。现病史

解析：本题考查口外病史记录。现病史（A对）是记述患者病后的全过程，即发生、发展、演变和诊治经过。